马齿苋的功效是
A. 凉血，养阴
B. 凉血，清肺
C. 凉血，通淋
D. 凉血，利咽
E. 凉血，定惊

正确答案：C。凉血，通淋

解析：本题考查的是马齿苋的功效。马齿苋的功效是凉血，通淋（C对）。马齿苋：【功效】清热解毒，凉血止血，通淋。生地黄：【功效】清热凉血，养阴（A错）生津，润肠。地骨皮：【功效】退虚热，凉血，清肺（B错）降火，生津。大青叶：【功效】清热解毒，凉血消斑，利咽（D错）消肿。水牛角：【功效】清热凉血，泻火解毒，定惊（E错）。